下列有关可摘局部义齿小连接体说法，不正确的是
A. 不能妨碍咬合
B. 不能滞留食物
C. 增强支持和稳定
D. 避免影响义齿就位
E. 位于牙齿邻间隙内的非倒凹区

正确答案：C。增强支持和稳定

解析：小连接体：小连接体的作用是把金属支架上的各部件，如卡环、支托、基托等与大连接体相连接。它与大连接体应呈直角、圆钝相连。小连接体垂直越过龈缘并缓冲。小连接体要有足够的硬度，位于牙齿邻间隙内的非倒凹区，避免影响义齿就位。不影响舌的运动，不干扰口腔软硬组织的解剖外形，不能妨碍咬合，也不能滞留食物。与基牙轴面建立导平面与导平面板的关系，帮助确定就位道，增强固位和稳定。掌握“局部义齿连接体”知识点。